属于提插补泻之补法操作的是
A. 先深后浅，轻插重提，提插幅度大
B. 先深后浅，轻插重提，提插幅度小
C. 先浅后深，重插轻提，提插幅度大
D. 先浅后深，重插轻提，提插幅度小
E. 先浅后深，重插重提，提插幅度大

正确答案：D。先浅后深，重插轻提，提插幅度小

解析：提插补泻为单式补泻手法的一种，先浅后深，重插轻提，以下插用力为主者为补法（D对）。提插幅度小的轻手法用于体质较弱或慢性疾病患者，重手法用于体质较强或急性病患者。